老年人的生理代谢特点，错误的是
A. 消化系统功能减退
B. 体脂增加、瘦体组织减少
C. 合成代谢增加、分解代谢降低
D. 免疫功能下降
E. 体内氧化损伤加重

正确答案：C。合成代谢增加、分解代谢降低